男性，10岁，左上中切牙有深楔状缺损，可探及露髓孔，探无感觉，X线检查发现根尖有大面积阴影。在进行根管治疗时，有关开髓部位的选择下列说法正确的是
A. 由于楔状缺损部位已经通髓腔，可以从楔状缺损处制备进入髓腔的洞形
B. 由于切牙的舌面窝髓壁薄，可以从舌面窝向牙颈部方向钻入
C. 由于切牙的髓腔形态与切牙的外形基本一致，可以从切端开始向牙根方向钻入
D. 只要能进入髓腔的任何一个部位都可以
E. 以上都不是

正确答案：B。由于切牙的舌面窝髓壁薄，可以从舌面窝向牙颈部方向钻入

解析：本题考查上中切牙的开髓方法。上中切牙舌面窝髓壁薄距离髓腔近，从此处钻入磨除牙体组织少，且方便揭全髓室顶，去除髓角处牙髓，便于使根管器械沿直线进入根管。开始时钻针方向与舌侧垂直，钻到釉牙骨质界后应立即改变钻针方向，向牙颈部方向钻入（B对），否则会形成唇侧台阶或出现颈部侧穿。虽然唇侧的楔状缺损部位已经通髓腔，但是不可以从楔状缺损处制备进入髓腔的洞形（A错），因为从此处钻入无法揭全髓室顶，近远中髓角暴露不充分，而遗留残髓，而从舌侧钻入只要不对牙体组织加力，即使唇侧颈部因楔缺牙体组织薄弱也不会导致牙折。切端距离髓腔远，如果从此处开髓，需磨除的牙体组织多，且该部位牙钻不容易放稳，开髓困难，再者此处是咬合受力部位后期充填后充填物易折裂，所以即使切牙的髓腔形态与切牙的外形基本一致，也不可以从切端开始向牙根方向钻入（C错）。开髓的原则是选择离髓腔最近且最容易揭全髓室顶的部位开髓，并不是能进入髓腔的任何一个部位都可以（D错）。